细胞外的K⁺及细胞内的Na⁺可通过Na⁺，K⁺-ATP酶逆浓度差跨膜转运，这种过程称为
A. 简单扩散
B. 滤过
C. 膜动转运
D. 主动转运
E. 易化扩散

正确答案：D。主动转运

解析：本题考查药物的转运方式。主动转运（D对）的特点是有载体的参加，有饱和现象，逆浓度梯度转运，需要消耗能量。一些生命必需物质（如K⁺，Na⁺，I⁻，单糖，氨基酸，水溶性维生素）和有机酸、碱等弱电解质的离子型化合物等，能通过主动转运吸收；简单扩散（A错）是被动转运中的一种；药物分子借助流体静压或渗透压随体液通过细胞膜的水性通道由细胞膜的一侧到达另一侧称为滤过（B错），为被动转运方式；膜动转运（C错）的特点是通过生物膜主动变形，将某些物质摄入细胞内或从细胞内释放到细胞外；易化扩散（E错）的特点是有载体的参加，有饱和现象，顺浓度梯度转运，不消耗能量。